川乌的化学成分主要是
A. 挥发油
B. 黄酮类
C. 香豆素类
D. 蒽醌类
E. 生物碱类

正确答案：E。生物碱类

解析：本题考查的是川乌中的主要化学成分。川乌的化学成分主要是生物碱（E对）。川乌中主要毒性生物碱及其化学结构：乌头和附子主要含二萜类生物碱，属于四环或五环二萜类衍生物。乌头生物碱的结构复杂、结构类型多。其重要和含量较高的有乌头碱、次乌头碱和新乌头碱，《中国药典》以三者为指标成分进行含量测定，要求三者总量应为0.050～0.17%。挥发油（A错）也称精油，是存在于植物体内的一类可随水蒸气蒸馏、与水不相混溶的挥发性油状液体。挥发油大多具有芳香气味，并具有多方面较强的生物活性，为中药所含有的一类重要化学成分。挥发油在植物来源的中药中分布非常广泛，特别是菊科、芸香科、伞形科、唇形科、樟科、木兰科、马兜铃科、败酱科、姜科、胡椒科、桃金娘科、马鞭草科等植物中都富含挥发油。此外，松科、柏科、杜鹃花科、木犀科、瑞香科、檀香科、蔷薇科等的某些植物中也含丰富的挥发油。黄酮类（B错）化合物广泛存在于自然界中，多存在于高等植物及羊齿类植物中。苔类中含有的黄酮类化合物为数不多，而藻类、霉菌、细菌中没有发现黄酮类化合物。香豆素类（C错）：香豆素是邻羟基桂皮酸的内酯，广泛分布于高等植物中，尤其以芸香科和伞形科为多见，少数发现于动物和微生物中。在植物体内，它们往往以游离状态或与糖结合成苷的形式存在。蒽醌类（D错）成分包括蒽酮及其不同还原程度的产物。按母核可分为单蒽核及双蒽核，按氧化程度又可分为氧化蒽酚、蒽酮、蒽酚及蒽酮的二聚物。含蒽醌类化合物的常用中药有大黄、虎杖、何首乌、芦荟、决明子等。